幼儿麻疹发热与出疹的关系是
A. 发热数小时～1天出疹
B. 发热1～2天出疹
C. 发热3～4天出疹，出疹时发热更高
D. 发热3～4天出疹，疹出热退
E. 发热与出疹无明显关系

正确答案：C。发热3～4天出疹，出疹时发热更高

解析：麻疹在发热3～4天左右开始出疹，先见于耳后、颈部，24小时内波及面部、躯干及上肢，于第3天皮疹累积下肢及足部。出疹期发热如潮，体温可达39℃～40℃，出疹3～4天后，皮疹按出疹的先后顺序消退，体温开始下降，全身情况也随之好转（C对）。风疹是发热1～2天后出疹（A错）。猩红热是于发热数小时～1天出疹（B错）。幼儿急疹是高热3-5天出疹，热退疹出（D错）。